胆囊呈梨形，位于胆囊窝内，胆囊分为胆囊底、胆囊体、胆囊颈和胆囊管4部分，有浓缩和储存胆汁的功能。关于胆囊的描述，正确的是
A. 有贮存和浓缩胆汁的功能
B. 胆囊上面不与肝相连
C. 胆囊底的体表投影位于左腹直肌外侧缘与左肋弓相交处
D. 胆囊动脉多不经过胆囊三角至胆囊
E. 分为底、体两部分

正确答案：A。有贮存和浓缩胆汁的功能

解析：胆囊有贮存和浓缩胆汁的功能(A对)，胆囊上面借结缔组织与肝相连(B错)，胆囊底的体表投影位于右腹直肌外缘与右肋弓交点处(C错)，胆囊动脉经过胆囊三角内(D错)，分为底、体、颈、管四部分(E错)。